正常人于下列哪个部位不能闻及支气管呼吸音
A. 肩胛下区
B. 喉部
C. 胸骨上窝
D. 背部第6颈椎附近
E. 以上均非

正确答案：A。肩胛下区

解析：正常人于喉部（B对）、胸骨上窝（C对）、背部第6、7颈椎（D对）及第1、2胸椎附近均可听到支气管呼吸音，且越靠近气管区，其音响越强，音调亦渐降低。肩胛下区（A错，为本题正确答案）听到的是支气管肺泡呼吸音。